女，35岁。因尿频、尿急、尿痛2天就诊。体检：体温38.5℃，右肾区叩痛明显，尿常规蛋白（++），白细胞满视野，红细胞10～15个/HP。根据[假设信息]，患者在1个月前尿细菌培养为变形杆菌，本次中段尿培养结果为大肠杆菌生长、菌落计数＞10⁵ml。此时应考虑
A. 慢性肾盂肾炎
B. 慢性间质性肾炎
C. 再感染
D. 复发
E. 以上都不是

正确答案：C。再感染

解析：青年女性，出现尿频、尿急、尿痛症状（典型膀胱刺激症状），体温38.5℃（急性肾盂肾炎时常有发热，体温多在38.0℃以上）、右肾区叩击痛（提示肾脏病变），尿常规蛋白（++）（正常尿蛋白阴性），白细胞满视野（正常0～5个/HP，患者存在白细胞尿，提示有尿路感染），红细胞10～15个/HP（存在镜下血尿，正常0～3个/HP），综合该患者的病史、体查、实验室检查，该患者诊断考虑为急性肾盂肾炎。根据[假设信息]，患者在1个月前尿细菌培养为变形杆菌，而此次结果为大肠杆菌，两种菌株不同，因此应考虑再感染（C对）。慢性肾盂肾炎（P493）（A错）病程常超过半年，多数患者有急性肾盂肾炎病史，后有不同程度的低热，尿频、排尿不适、腰部酸痛呈间歇性，症状常较急性期轻且不典型，可伴夜尿增多、低比重尿等肾小管功能受损表现。慢性间质性肾炎（P490）（B错）多缓慢隐袭进展，常表现为早期夜尿多、低比重及低渗透压尿，伴肾小管酸中毒，尿常规变化轻微，仅有轻度蛋白尿，少量红、白细胞及管型。复发（P491）（D错）的菌尿菌种应与上次相同。